属于氨基糖苷类抗生素的有
A. 阿米卡星
B. 庆大霉素
C. 妥布霉素
D. 卡那霉素
E. 依替米星

正确答案：A、B、C、D、E。阿米卡星；庆大霉素；妥布霉素；卡那霉素；依替米星

解析：本题考查氨基糖苷类抗生素。氨基糖苷类抗菌药物包括阿米卡星（A对）、庆大霉素（B对）、妥布霉素（C对）、卡那霉素（D对）、依替米星（E对）、奈替米星等。